皮肤病大片潮红而无渗液者，外治应首选
A. 金黄散
B. 玉露散
C. 桃花散
D. 三石散
E. 青黛散

正确答案：E。青黛散

解析：青黛散由青黛、黄柏、滑石、石膏组成。属于清热收涩药，具有清热收涩止痒的功效，适用于一切皮肤病急性或亚急性皮炎而无渗液，大片潮红者（E对）。金黄散（A错）、玉露散（B错）具有箍集围聚、收束疮毒的功效，可用于红肿热痛明显的阳证疮疡。桃花散（C错）具有收涩凝血的作用，适用于溃疡出血、创伤出血证。三石散（D错）具有清热止痒，收涩生肌的功效，适用于一切皮肤病急性或亚急性皮炎而渗夜不多，无红热者。